蒽醌类化合物的质谱中依次脱去的基团是
A. 羰基
B. 醛基
C. 羧基
D. 羟基
E. 乙烯

正确答案：A。羰基

解析：本题考查的是蒽醌类的质谱特征。蒽醌类化合物的质谱中依次脱去的基团是羰基（A对）。蒽醌类化合物的质谱有共同的特征：分子离子峰通常为基峰，而且常丢失一至两个分子的羰基的碎片离子峰。